唇腭裂综合序列疗法，患儿1个月首选治疗
A. 唇裂修复术
B. 腭裂修复术
C. 语音，腭咽闭合功能评价
D. 牙糟突植骨修复术
E. 鼻唇继发畸形矫正术

正确答案：A。唇裂修复术

解析：本题考查唇腭裂的序列疗法。唇腭裂综合序列疗法，患儿1个月首选治疗唇裂修复术（A对）。一般建议，唇裂整复术的年龄以3～6个月为宜，体重达5～6kg 以上。早期进行手术，可以尽早地恢复上唇的正常功能和外形，并可使瘢痕组织减少到最小程度。腭裂修复术（B错）归纳起来大致有两种意见，一种主张早期手术，约在8～18个月为宜；另一种意见则认为在学龄前，即5～6岁施行为好。语音，腭咽闭合功能评价（C错）常在腭裂术后根据患儿恢复情况进行评价。牙槽突植骨术（D错）宜在9～11岁进行。鼻唇继发畸形矫正术（E错）的最佳时间为女性16岁以后，男性17～18岁以后进行。